流行性出血热出现全身中毒症状的时期是
A. 发热期
B. 低血压休克期
C. 少尿期
D. 多尿期
E. 恢复期

正确答案：A。发热期

解析：流行性出血热发热期急性起病，畏寒，发热，体温多为39～40℃，以稽留热和弛张热多见。一般持续3～7日，同时可出现中毒症状、毛细血管损害和肾损害。热程越长，病情越重。轻者热退后症状缓解，重者热退后病情反而加重。全身中毒症状为全身酸痛、“三痛”（头痛、腰痛和眼眶痛），嗜睡或失眠、烦躁、谵妄等神经中毒症状，食欲不振、恶心、呕吐、腹痛、腹泻、呃逆等胃肠道症状（A对）。流行性出血热低血压休克期一般发生于第4～6病日，迟者8～9病日。多于发热末期、发热同时或热退后出现。本期持续时间短者数小时，长者可达6日以上，一般为1～3日。持续时间的长短与病情轻重和治疗措施是否及时和正确有关。一般血压开始下降时四肢尚温，随着低血压进行性加剧出现面色苍白、四肢厥冷、口唇及肢端紫绀、脉搏细弱、尿量减少等休克表现。过久的组织血流灌注不足，可引起 DIC、脑水肿、急性呼吸窘迫综合征（ARDS）和急性肾衰竭（B错）。流行性出血热少尿期一般发生于第5～8病日，持续时间短者1日，长者可达十余日，一般2～5日。可与休克期重叠，或由发热期直接进入少尿期。此期主要表现为少尿（24小时尿量少于400mL）或无尿（24小时尿量少于100mL），可引起尿毒症、酸中毒、水和电解质紊乱、高血容量综合征和肺水肿等。表现为烦躁不安或嗜睡、神志恍惚、谵妄甚至昏迷、抽搐等，以及水肿、顽固性呃逆、呕吐、头痛、头晕、呼吸增快、心律失常、血压增高、脉压差增大等症。在治疗过程中若补液过多、则极易诱发心衰、肺水肿及脑水肿等。此期皮肤、内脏出血现象加重。由于抵抗力下降易继发感染，如肺部感染等。少数患者无明显少尿而存在氮质血症，称为无少尿型肾功能（C错）。流行性出血热多尿期一般发生于第9～14病日，持续时间短者1日，长者可达数月之久，一般7～14日。根据尿量和氮质血症的情况可分为以下三期：1.移行期 每日尿量由400mL增至2000mL，但血尿素氮和肌酐等反而升高，症状亦加重。部分患者因并发症死于此期，应注意观察。2.多尿早期 每日尿量超过2000mL，氮质血症无明显改善，症状仍重。3.多尿后期 每日尿量超过3000mL，并逐日增加，可达4000～8000mL，少数可达1500mL以上。此期氮质血症逐渐减轻，精神食欲好转，但若水和电解质补充不足或继发感染，可发生继发性休克，亦可发生低血钾、低血钠等不全，这是肾小球受损而肾小管受损不严重所致。病情轻重与少尿持续时间和氮质血症的程度相平行，若血尿素氮（BUN）每日上升21mmol/L以上为高分解型肾衰竭，预后较差（D错）。流行性出血热恢复期每日尿量恢复至2000mL以下，症状基本消失，精神食欲基本恢复，体力日渐增加，一般需要1～3个月才能恢复至正常。部分患者仍有乏力、多汗等症状，少数可遗留高血压、肾功能障碍、心肌劳损和垂体功能减退等（E错）。